缩余釉上皮形成于
A. 釉质形成时期
B. 牙本质形成时期
C. 牙根形成时期
D. 釉质发育完成后
E. 牙齿萌出时

正确答案：D。釉质发育完成后

解析：釉质发育完成后，成釉细胞、中间层细胞与外釉上皮细胞结合，形成一层鳞状上皮覆盖在釉小皮上，称为缩余釉上皮。掌握“牙体、牙周组织的形成”知识点。